来源于间叶组织的恶性肿瘤通常称为
A. 良性肿瘤
B. 恶性肿瘤
C. 肉瘤
D. 临界瘤
E. 瘤样病变

正确答案：C。肉瘤

解析：肉瘤：来源于间叶组织的恶性肿瘤通常称为肉瘤。掌握“肉瘤”知识点。